能够避免肝脏对药物的破坏作用（首关效应）的片剂是
A. 舌下片
B. 咀嚼片
C. 分散片
D. 泡腾片
E. 肠溶片

正确答案：A。舌下片

解析：本题考查片剂。舌下片（A对）系指置于舌下能迅速溶化，药物经舌下黏膜吸收发挥全身作用的片剂，不经过胃肠道，避免了胃肠道和肝脏对药物的破坏作用（首关效应）。咀嚼片（B错）、分散片（C错）、泡腾片（D错）和肠溶片（E错）都需经过胃肠道，无法避免肝脏对药物的破坏（首关效应）。